可通过完整的皮肤和粘膜吸收的是
A. 无机铅化合物
B. 四乙基铅
C. 金属铅
D. 铅合金

正确答案：B。四乙基铅

解析：本题考查可透过皮肤屏障的物质。皮肤对外来化合物具有屏障作用，但确有不少外来化合物可经皮肤吸收，如芳香族氨基和硝基化合物、有机磷酸酯类化合物、氨基甲酸酯类化合物、金属有机化合物（四乙铅（B对ACD错））等，可通过完整皮肤，主要通过表皮细胞，吸收入血而引起中毒。